女性，26岁，已婚。突发尿痛、尿频、尿急，腹痛半天。检查：肾区无叩击痛，尿白细胞（++），中段尿细菌培养为大肠杆菌。其诊断是
A. 急性肾盂肾炎
B. 肾结核
C. 急性膀胱炎
D. 肾结石
E. 慢性肾炎

正确答案：C。急性膀胱炎

解析：患者青年女性，已婚（尿路感染的高发人群），突发尿痛、尿频、尿急（尿路刺激征的典型表现），伴有腹痛，肾区无叩击痛（提示下尿路感染），尿白细胞（++）（正常阴性，提示有白细胞尿），中段尿细菌培养为大肠杆菌（提示有真性菌尿，确诊为尿路感染），综合该患者的病史、体查、尿细菌培养，该患者诊断考虑为急性膀胱炎（C对）。急性肾盂肾炎（P498）（A错）有寒战、高热、头痛、全身酸痛等症状，腰痛、肾区叩击痛明显。 肾结核（八版外科学P561-P562）（B错）除明显的膀胱刺激征外，常有终末血尿，可伴典型结核症状，普通尿细菌培养阴性。肾结石（八版外科学P575-P576）（D错）的典型表现为阵发性腰部或上腹部剧烈疼痛，查体肾区叩击痛明显，伴恶心、呕吐等症状，多有镜下血尿。 慢性肾炎（P474）（E错）起病缓慢，病程较长，主要表现为蛋白尿、血尿、高血压和水肿等。